现场调查研究方法不包括
A. 病例对照研究
B. 现况调查
C. 自然试验
D. 队列研究
E. 描述性研究

正确答案：C。自然试验

解析：本题考查现场调查研究方法。现场调查研究方法包括：病例对照研究（A对）、现况调查（B对）、队列研究（D对）、描述性研究（E对）。自然试验（C错，为本题正确答案）指一种受试个体（群体）被自然地或被其他非观察者控制因素暴露在试验或控制条件下的一种试验研究方法。